黄某，2003年11月因医疗事故受到吊销医师执业证书的行政处罚。2004年11月向当地卫生行政部门申请重新注册，卫生行政部门经过审查，决定对黄某不予注册。理由是黄某的行政处罚自处罚决定之日起至申请注册之日止不满
A. 1年
B. 2年
C. 3年
D. 4年
E. 5年

正确答案：B。2年

解析：医师不予注册：有下列情形之一的，不予注册：①不具有完全民事行为能力的；②因受刑事处罚，自刑罚执行完毕之日起至申请注册之日止不满2年的；③受吊销医师执业证书行政处罚，自处罚决定之日起至申请注册之日止不满2年的；④有国务院卫生行政部门规定不宜从事医疗、预防、保健业务的其他情形的。掌握“执医概述及考试和注册”知识点。